生产性粉尘是指在生产过程中产生的能较长时间漂浮在空气中的
A. 烟
B. 雾
C. 固体微粒
D. 液体微滴
E. 气溶胶

正确答案：C。固体微粒